鉴定鱼肉类鲜度最常用的化学指标为
A. 羰基价
B. K值
C. TVBN
D. 过氧化物值
E. 酸价

正确答案：B。K值